患者，男，60岁。慢性支气管炎病史20年，近半年活动后心悸，气短。查体：有肺气肿体征，两肺散在干、湿啰音、剑突下可见心尖搏动，肺动脉瓣区第二心音亢进，应首先考虑的是
A. 冠心病
B. 肺心病
C. 风心病
D. 高血压性心脏病
E. 心肌炎

正确答案：B。肺心病

解析：患者中老年男性，有慢性支气管炎病史，近半年活动后心悸，气短，有肺气肿体征，两肺散在干、湿啰音、剑突下可见心尖搏动，肺动脉瓣区第二心音亢进，患者临床表现与肺心病相符，故患者应首先考虑的是肺心病（B对）。冠心病（A错）主要表现为胸骨后濒死样疼痛，程度重，持续时间长，胸痛可在休息时发生。风心病（P298）（C错）主要表现为心脏瓣膜受累而出现的呼吸困难、咳嗽、咯血等症状。高血压性心脏病（D错）在心功能代偿期，病人无明显症状；在心功能失代偿期，可出现左心衰竭的症状，开始时仅在劳累、饱食或说话过多时感心悸、气喘、咳嗽，以后症状逐渐加重，多表现为夜间阵发性呼吸困难并痰中带血，严重时可发生急性肺水肿。心肌炎（P283）（E错）轻者可完全没有症状，重者甚至可出现心源性休克，多数患者有病毒感染前驱症状，如发热、全身倦怠感等，随后出现心悸、胸痛、呼吸困难、水肿等症状。